某70岁女患者，因尿路感染于10天前开始服用氨苄青霉素，现出现腹泻。取标本，培养出大量革兰阳性葡萄球菌。病人腹泻的机制是
A. 菌群失调
B. 肠毒素使腺苷环化酶活性增加
C. 细菌侵袭肠黏膜所致
D. 内毒素作用于肠黏膜
E. 肠蠕动加快

正确答案：A。菌群失调

解析：70岁女性患者，为治疗尿路感染服用氨苄青霉素（抗生素）10天，现出现腹泻，粪便标本培养出大量革兰阳性葡萄球菌，诊断为抗生素相关性腹泻，腹泻的机制是肠道菌群失调（A对）。菌群失调指用抗菌药物治疗某种原感染性疾病的过程中，导致宿主某部位寄居细菌的种群发生改变或各种群的数量比例发生大幅度变化，因为长期或大量应用抗生素后，正常菌群被抑制或杀灭，而原处于数量恶劣的菌群或外来耐药菌趁机大量繁殖而导致的感染，引起二重感染的常见细菌有金黄色葡萄球菌、白假丝酵母菌和一些革兰阴性杆菌，临床表现有假膜性肠炎、鹅口疮、肺炎、泌尿道感染或败血症等。